全口义齿人工后牙排成反（牙合）的指标是
A. 当下牙弓大于上牙弓时
B. 上下牙槽嵴顶的连线与（牙合）平面的交角明显小于80°时
C. 上颌牙槽嵴丰满，下颌牙槽嵴低平患者
D. 上颌牙槽嵴低平，下颌牙槽嵴丰满患者
E. 下颌习惯性前伸患者

正确答案：B。上下牙槽嵴顶的连线与（牙合）平面的交角明显小于80°时

解析：本题考查全口义齿人工后牙排成反（牙合）的指标。上下牙槽嵴顶的连线与（牙合）平面的交角明显小于80°，即下牙弓宽于上牙弓，如果排列成正常（牙合），则下后牙需要舌倾，上后牙需要颊倾以使后牙尖窝接触，但由于后牙倾斜，使（牙合）力不能垂直于牙槽嵴传导，易产生侧向力，损伤牙槽嵴且义齿不稳定（B对）。当下牙弓大于上牙弓（A错），但上下牙槽嵴顶的连线与（牙合）平面的交角大于80°时，认为上下颌骨关系正常，可以排列成正常的尖窝接触关系。上颌牙槽嵴丰满，下颌牙槽嵴低平患者（C错）或上颌牙槽嵴低平，下颌牙槽嵴丰满患者（D错），只要上下牙槽嵴顶的连线与（牙合）平面的交角没有明显小于80°，可以排成正常（牙合），必要时减少后牙覆盖，也可采用舌向集中（牙合）或线性（牙合）。下颌习惯性前伸患者（E错）,应排列成正常（牙合），纠正下颌前伸，达到神经、肌肉、关节以及（牙合）的平衡。